下列病毒性疾病中，血白细胞总数及中性粒细胞比例升高的是
A. 病毒性肝炎
B. 麻疹
C. 艾滋病
D. 流行性腮腺炎
E. 流行性乙型脑炎

正确答案：E。流行性乙型脑炎

解析：流行性乙型脑炎白细胞总数增高，一般在（10～20）×10⁹/L，个别甚至更高，中性粒细胞在80%以上，部分患者血象始终正常（E对）。急性肝炎初期白细胞总数正常或略高，黄疸期白细胞总数正常或稍低，淋巴细胞相对增多，偶可见异型淋巴细胞。重型肝炎时白细胞可升高，红细胞及血红蛋白可下降，肝炎肝硬化伴脾功能亢进者可有血小板、红细胞、白细胞减少的‘三少现象’”（A错）。麻疹白细胞总数减少，淋巴细胞比例相对增多。如果白细胞数增加，尤其是中性粒细胞增加，提示继发细菌感染。若淋巴细胞严重减少，常提示预后不好（B错）。艾滋病白细胞、血红蛋白、红细胞及血小板均可有不同程度减少。尿蛋白常阳性（C错）。流行性腮腺炎白细胞计数和尿常规一般正常，有睾丸炎者白细胞可以增高，有肾损害时尿中可出现蛋白和管型（D错）。